以下哪种牙体缺损不能用充填的方法治疗
A. 后牙（牙合）面洞
B. 前牙切角缺损
C. 需抬高咬合
D. 后牙邻（牙合）洞
E. 楔状缺损

正确答案：C。需抬高咬合

解析：本题考查充填修复的适应证。抬高咬合可进行全冠或高嵌体修复（C错，为本题的正确答案）。后牙（牙合）面洞（A对）、前牙切角缺损（B对）、后牙邻（牙合）洞（D对）、楔状缺损（E对）均是充填修复的适应症。